男，35岁。纳差、腹胀2个月。查体：浅表淋巴结未触及，巩膜无黄染，肝肋下未触及，脾肋下8.5cm，质硬。化验血常规：Hb100g/L，WBC67.7×10⁹/L，原始细胞0.02，早幼粒细胞0.02，中幼粒细胞0.13，晚幼粒细胞0.18，杆状核粒细胞0.08，分叶粒细胞0.37，E0.06，B0.09，L0.04，M0.01，Plt543×10⁹/L。该患者最可能的诊断是
A. 急性早幼粒细胞白血病
B. 巨幼细胞贫血
C. 骨髓纤维化
D. 慢性粒细胞白血病
E. 慢性淋巴细胞白血病

正确答案：D。慢性粒细胞白血病

解析：患者男（男性发病多于女性），纳差、腹胀2个月，查体脾肋下8.5cm，质硬（脾大为慢性粒细胞白血病最显著体征，常达脐或脐以下，质地坚实，由于脾大而产生上腹坠胀感）。化验血常规：Hb100g/L，WBC67.7×10⁹/L（正常值为4～10×10⁹/L，白细胞数明显增高），原始细胞0.02，早幼粒细胞0.02，中幼粒细胞0.13，晚幼粒细胞0.18，杆状核粒细胞0.08（正常值为0～5%），分叶粒细胞0.37（正常值为50～70%），E0.06（正常值为0.5～5%），B0.09（正常值为0～1%，嗜碱性粒细胞增多有助于诊断），L0.04（正常值为20～40%），M0.01（正常值为3～8%），Plt543×10⁹/L（正常值为100～300×10⁹/L，近半数病人可出现血小板增多）。综和该患者症状、体征和实验室检查，该患者诊断考虑为慢性粒细胞白血病（D对）。急性早幼粒细胞白血病（A错）巨脾罕见，血象常有不同程度的正常细胞性贫血，少数病人血片上红细胞大小不等，可找到幼红细胞，约50%的病人血小板＜60×10⁹/L。巨幼细胞贫血（B错）不会出现巨脾，血象呈大细胞性贫血，MCV，MCH均增高，MCHC正常，中性粒细胞核分叶过多（5叶核占5%以上或出现6叶以上核），亦可见巨型杆状核粒细胞。骨髓纤维化（C错）有严重贫血和出血的临床表现，血象示正常细胞性贫血，外周血有少量幼红细胞。成熟红细胞形态大小不一，常发现泪滴形红细胞，有辅助诊断价值。白细胞数增多或正常，可见中幼及晚幼粒细胞。慢性淋巴细胞白血病（E错）血象以淋巴细胞持续性增多为主要特征，外周血B淋巴细胞绝对值≥5×10⁹/L （至少持续3个月），中性粒细胞比值降低。